男，48岁。一年来每于剧烈活动时或饱餐后发作剑突下疼痛，向咽部放射，持续数分钟可自行缦解。2周来在乡镇出差，发作频繁且有夜间睡眠中发作，2小时来疼痛剧烈，不能缓解，向胸部及后背部放射，伴憋闷、大汗。此时最有助诊断的辅助检查是
A. 超声心动图
B. 胸部X线片
C. 心电图
D. 心肌酶
E. CT

正确答案：C。心电图